患儿，3岁。筋骨萎弱，发育迟缓，坐、立、行走、牙齿的发育都晚于同龄小儿，颈项萎软，天柱骨倒，目无神采，夜卧不安，舌淡，苔少。其证候是
A. 脾肾气虚
B. 痰瘀阻滞
C. 肝肾亏损
D. 心脾两虚
E. 肾阳亏虚

正确答案：C。肝肾亏损

解析：题中患儿筋骨萎弱，发育迟缓，坐、立、行走、牙齿的发育都晚于同龄小儿，故诊断为小儿五迟。肾主骨，肝主筋，齿为骨之余，由于肝肾精血不足，不能营养筋骨，筋骨不健，故筋骨萎弱，发育迟缓，坐、立、行走、牙齿的发育都晚于同龄小儿，颈项萎软，天柱骨倒，精血不足，不能上荣头面，充盈脑髓，故目无神采，精血不足，心失所养，故夜卧不安。舌淡，苔少为肝肾亏虚之象，故辨为肝肾亏虚证（C对）（A错）。舌淡，苔少明显非痰瘀阻滞的表现（B错）。心脾两虚多有语言发育迟滞，精神呆滞，智力低下，头发生长迟缓，发稀萎黄，四肢痿软，手足失用，口角流涎等症状（D错）。肾阳亏虚小儿多伴大便久泻，完谷不化，面色白等症状（E错）。